阿米卡星的临床应用错误的是
A. 阿米卡星单独使用效果更好
B. 它与β-内酰胺类联合应用可获协同作用
C. 对氨基糖苷类耐药菌感染能控制
D. 对肠道G-杆菌产生氨基糖苷类灭活酶稳定
E. 对铜绿假单胞菌产生多种氨基糖苷类灭活酶稳定

正确答案：A。阿米卡星单独使用效果更好

解析：其突出优点是对肠道G-杆菌和铜绿假单胞菌所产生的多种氨基糖苷类灭活酶稳定，故对一些氨基糖苷类耐药菌感染仍能有效控制，常作为首选药。本品的另一个优点是它与β-内酰胺类联合应用可获协同作用，当粒细胞缺乏或其他免疫缺陷患者合并严重G-杆菌感染时，合用药比阿米卡星单独使用效果更好。掌握“氨基糖苷类抗生素”知识点。